能补气、养血、调经的中成药是
A. 痛经丸
B. 妇康片
C. 妇科得生丸
D. 元胡止痛片
E. 痛经灵颗粒

正确答案：B。妇康片

解析：本题考查的是妇康片的功能。能补气、养血、调经的中成药是妇康片（B对）。妇康片【功能】补气，养血，调经。痛经丸（A错）【功能】活血散寒，调经止痛。妇科得生丸（C错）【功能】解郁调经。元胡止痛片（D错）【功能】理气，活血，止痛。痛经灵颗粒（E错）【功能】活血化瘀，理气止痛。